35岁，曾生育2女孩，近半年来月经不调，8～20/26天，基础体温双相，月经第6天刮出子宫内膜病理为：仍可见分泌期内膜应考虑什么诊断
A. 更年期月经紊乱
B. 不全流产
C. 黄体发育不全
D. 黄体萎缩不全
E. 无排卵型功血

正确答案：D。黄体萎缩不全

解析：无排卵性功血：基础体温单相，子宫内膜不出现分泌期改变。黄体功能不足：基础体温双相，内膜活检显示分泌反应落后2日。子宫内膜不规则脱落（黄体萎缩不全）：基础体温双相，下降缓慢，月经期第5～6天仍能见呈分泌反应的子宫内膜。黄体功能不足：基础体温双相，内膜活检显示分泌反应落后2日。子宫内膜不规则脱落（黄体萎缩不全）：基础体温双相，下降缓慢，月经期第5～6天仍能见呈分泌反应的子宫内膜。此题考虑：黄体萎缩不全。掌握“功能失调性子宫出血”知识点。